患者，男，48岁。因鼻部破损引起头额红肿，两目肿胀不能外视，伴形寒发热，舌红苔黄腻，脉滑数。治疗应首选
A. 化斑解毒汤
B. 普济消毒饮
C. 龙胆泻肝汤
D. 五神汤
E. 仙方活命饮

正确答案：B。普济消毒饮

解析：皮肤突然发红，色如涂丹的一种急性感染性疾病，称为丹毒。该患者因鼻部破损引起头额红肿，两目肿胀不能外视，伴形寒发热，舌红苔黄腻，脉滑数，符合丹毒特点。内治以凉血清热，解毒化淤为原则。发于头面者，用普济消毒饮加减（B对）。化斑解毒汤用于丹毒发于胸腹腰胯者（A错），龙胆泻肝汤也可用于此证（C错）。五神汤合萆薢渗湿汤用于丹毒发于下肢者（D错）。仙方活命饮用于痈之湿热壅滞证（E错）。